身热反不恶寒，四肢厥逆，下利清谷，脉微欲绝，病机属于
A. 阴阳格拒
B. 阴阳互损
C. 阴阳亡失
D. 阴阳偏盛
E. 阴阳偏衰

正确答案：A。阴阳格拒

解析：本题考查的是阴阳失调病机。身热反不恶寒，四肢厥逆，下利清谷，脉微欲绝，病机属于阴阳格拒（A对）。阴阳失调，即是阴阳消长失去平衡协调的简称。是指机体在疾病的发生发展过程中，由于各种致病因素的影响，导致机体阴阳消长失去相对的平衡，从而形成阴阳偏盛、偏衰，或阴不制阳、阳不制阴的病变状态。因此，阴阳失调，是中医学的基本病机之一，是人体阴精、阳气等各种生理性矛盾和关系遭到破坏的概括，是疾病发生、发展的内在根据。阴阳失调病机，是以阴阳的属性，阴和阳之间所存在的相互制约、相互消长、互根互用和相互转化的理论，来阐释、分析、综合机体一切病变现象的机制，形成了阴阳偏盛偏衰、阴阳互损、阴阳格拒、阴阳亡失等病机的概念及以寒热变化为主的证候。阴阳的偏盛和偏衰之间，亡阴和亡阳之间，都存在着内在的密切联系。也就是说，阴阳失调的各种病机，并不是固定不变的，而是随着病情的进退和邪正的盛衰等情况的变化而变化，因此，必须随时观察和掌握阴阳失调病机的不同变化，方能把握住疾病发生、发展的本质。1.阴阳偏盛（D错）：又称“阴阳偏胜”，阴或阳的偏盛，主要是指“邪气盛则实”的实证。病邪侵入人体，必从其类。阳邪侵入人体，可形成阳偏盛，阴邪侵入人体，可形成阴偏盛。阳盛则热，阴盛则寒，明确地指出了阳偏盛和阴偏盛病机的临床表现特点。2.阴阳偏衰（E错）：阴或阳的偏衰，是指“精气夺则虚”的虚证。“精气夺”，实质上是包括了机体的精、气、血、津液等基本物质的不足及其生理功能的减退，同时也包括了脏腑、经络等生理功能的减退和失调。3.阴阳互损（B错）：阴阳互损，是指阴或阳任何一方虚损到相当程度，病变发展影响及相对的一方，形成阴阳两虚的病变机制。由于肾藏精气，内寓真阴真阳，为全身阳气阴液之根本，因此，一般而言，无论阴虚或阳虚，多损及肾的阴阳，在肾本身阴阳失调的情况下，才易于产生阴损及阳或阳损及阴的阴阳互损病理变化。4.阴阳格拒：阴阳格拒，是阴阳失调病机中比较特殊的一类病机。形成阴阳相互格拒的机制，主要是在病变过程中阴或阳的一方偏盛至极，或阴和阳的一方极端虚弱，双方盛衰悬殊，盛者壅遏于内，将虚弱、不足的一方排斥格拒于外，迫使阴阳之间不相维系，从而出现真寒假热或真热假寒的复杂病变现象，即阴阳格拒。（1）阴盛格阳：阴盛格阳，是指阴寒之邪壅盛于内，逼迫阳气浮越于外，使阴阳之气不相顺接、相互格拒，表现为真寒假热的病机变化。病变本质是阴寒内盛，临床可见四肢厥逆、下利清谷、脉微欲绝等症状；又可见阳浮于外，症见身热反不恶寒（但欲盖衣被）、面颊泛红等假热之象。（2）阳盛格阴：阳盛格阴，是指邪热过盛，深伏于里，阳气被遏，郁闭于内，不能外透布达于肢体，从而形成阴阳排斥，而格阴于外，表现为真热假寒的病机变化。病变本质是阳热内盛，临床可见身热、面红、气粗、烦躁等症状外；又突然出现四肢厥冷（但身热不恶寒）、脉象沉伏（但沉数有力）等假寒之象。5.阴阳亡失（C错）：阴阳亡失是机体的阴液或阳气突然大量地亡失，导致生命垂危的一种病变状态。阴精和阳气是人体生命活动的根本物质，两者是相互依存，相互资生的对立统一体，当疾病发展至严重阶段时，不仅消耗阴精而使之亏竭，而且亦可劫夺阳气而使之衰脱。故阴阳亡失，实际上即是这两大类生命物质互根关系的解体。阴精亏竭，可迅速导致阳脱，而阳气脱失，亦可立即导致阴竭。阴阳亡失包括亡阴和亡阳两类，两者既有区别，又有联系。阴阳亡失包括亡阴和亡阳两类，两者既有区别，又有联系。